副溶血性弧菌食物中毒常见中毒食品为
A. 动物性食品、凉拌菜、水产品
B. 淀粉类食品、剩米饭、奶制品
C. 海产品、受海产品污染的咸菜
D. 自制发酵食品、臭豆腐、面酱
E. 动物性食品、病死牲畜肉、蛋类

正确答案：C。海产品、受海产品污染的咸菜